具有二氢吡啶结构的钙通道拮抗剂是
A. 盐酸地尔硫䓬
B. 硝苯地平
C. 盐酸普萘洛尔
D. 硝酸异山梨酯
E. 盐酸哌唑嗪

正确答案：B。硝苯地平

解析：本题考查硝苯吡啶。硝苯吡啶（B对）为1，4-二氢吡啶类钙通道阻滞剂。盐酸地尔硫䓬（A错）是具有硫氮杂䓬结构的钙通道阻滞剂。盐酸普萘洛尔（C错）是具有氨基醇结构的非选择性β受体阻滞剂。硝酸异山梨酯（D错）是具有酯类结构的血管扩张药。盐酸哌唑嗪（E错）是具有苯并嘧啶结构的α受体阻滞剂。